女，35岁。闭经3年，内分泌检查血FSH55U/L。最可能的诊断是
A. 卵巢性闭经
B. 垂体性闭经
C. 子宫性闭经
D. 肾上腺性闭经
E. 下丘脑性闭经

正确答案：A。卵巢性闭经

解析：该患者为年轻女性，闭经3年，内分泌检查血FSH55U/L（＞40U/L），最可能的诊断是卵巢早衰，为卵巢性闭经（A对）。下丘脑性闭经（P353）（E错）的特点是下丘脑合成和分泌的GnRH缺陷或下降导致垂体促性腺激素（Gn），即卵泡刺激素（FSH），特别是黄体生成素（LH）的分泌功能低下。垂体性闭经（P354）（B错），主要病变在垂体。表现为腺垂体功能病变或功能失调。子宫性闭经（P354）（C错）闭经原因在子宫，表现为月经调节功能正常，第二性征发育也正常，但该患者FSH异常，故排除之。肾上腺性闭经（P355）（D错）为肾上腺皮质功能亢进或肾上腺皮质肿瘤引起的闭经，无FSH激素水平的改变。